佝偻病肋骨串珠特点哪项是错误的
A. 好发于1岁左右小儿
B. 部位在肋骨与肋软骨交界处
C. 可扪及圆形隆起
D. 骨样组织堆积所致
E. 以胸骨旁最明显

正确答案：E。以胸骨旁最明显

解析：佝偻病活动期（激期）胸部：胸廓畸形多见于1岁左右小儿，如佝偻病肋骨串珠，肋膈沟（郝氏沟），鸡胸，漏斗胸。肋骨串珠在7～10肋骨最明显。掌握“维生素D缺乏性佝偻病”知识点。